治疗急性胃炎食积气滞证，应首选
A. 香苏散合良附丸加减
B. 清中汤加减
C. 保和丸加减
D. 柴胡疏肝散加减
E. 失笑散合丹参饮加减

正确答案：C。保和丸加减

解析：保和丸为消食、导滞、和胃的传统中成药，用于食积停滞，脘腹胀满，嗳腐吞酸，不欲饮食的治疗（C对）。香苏散合良附丸加减治疗寒邪客胃证（A错）。清中汤加减治疗湿热中阻证（B错）。柴胡疏肝散加减治疗肝胃不和证（D错）。失笑散合丹参饮加减治疗瘀血阻络证（E错）。